不属于肾窦内的结构有
A. 肾大、小盏
B. 肾盂
C. 肾动、静脉
D. 肾乳头
E. 脂肪组织和淋巴管

正确答案：D。肾乳头

解析：肾窦内容纳肾血管、肾小盏（C对）、肾大盏（A对）、肾盂（B对）和脂肪（E对）等结构。肾乳头（D错，为本题正确答案）由2 ~3 个肾锥体尖端合并而成，属于肾实质内容，不在肾窦内。